断片
A. 染色体的非染色带无线状连接
B. 染色体的非染色带有线状连接
C. 光镜下不可见的DNA缺失
D. 远离原位的染色体断裂节段
E. 有染色质缺失的染色体

正确答案：D。远离原位的染色体断裂节段

解析：本题考查断片。断片是指远离原位的染色体断裂节段（D对ABCE错）。